能够促进变形链球菌定植于根面的细菌是
A. 血链球菌
B. 轻链球菌
C. 变形链球菌
D. 乳杆菌
E. 放线菌

正确答案：E。放线菌

解析：黏性放线菌促进变形链球菌定植于根面，对根面菌斑形成及根面龋的发生可能有重要的协同作用。掌握“龋病概述”知识点。